某肺心病患者，因肺部感染入院，血气分析结果：pH7.33，PaCO₂9.3kPa(70mmHg),HCO₃⁻36mmol/L.应诊断为
A. 代谢性酸中毒
B. 代谢性碱中毒
C. 急性呼吸性酸中毒
D. 慢性呼吸性酸中毒
E. 慢性呼吸性酸中毒合并代谢性碱中毒

正确答案：D。慢性呼吸性酸中毒

解析：肺心病患者可因过度通气而发生慢性呼吸性酸中毒（D对）,这时PaCO₂原发性升高（正常范围为33~46 mmHg）导致PH下降（正常值为7.35~7.45），但由于由于肾的代偿作用，慢性呼吸性酸中毒可以呈代偿性，随PaCO₂升高，HCO₃⁻也呈比例增高（正常为22~27 mmoI/L），所以PH值变化不太明显。